崩漏的治疗原则是
A. 塞流与澄源结合
B. 澄源与复旧结合
C. 复旧与塞流结合
D. 固本与澄源结合
E. 急则治标，缓则治本

正确答案：E。急则治标，缓则治本

解析：崩漏的治疗原则为“急则治其标，缓则治其本”，当崩漏处于出血期时应根据急则治其标的原则，首当给予止血治疗，如果止血后，当根据缓则治其本的原则，给予固本善后的治疗（E对）。塞流即指止血，是用于暴崩之际的一种方法，是治疗崩漏出血期的首要方法；澄源即指正本清源，是治疗崩漏的重要阶段，用于出血缓解后的治疗（A错）。澄源即指正本清源，是治疗崩漏的重要阶段，用于出血缓解后的治疗；复旧即指固本善后，是巩固崩漏治疗的重要阶段，用于止血后恢复健康（B错）。复旧即指固本善后，是巩固崩漏治疗的重要阶段，用于止血后恢复健康；塞流即指止血，是用于暴崩之际的一种方法，是治疗崩漏出血期的首要方法（C错）。固本即复旧，是治疗崩漏、止血后恢复健康的一种方法；澄源即指正本清源，是治疗崩漏的重要阶段，用于出血缓解后的治疗（D错）。